女性，30岁，2天来进行性双下肢瘫痪，大小便障碍，体温正常。胸4水平以下深浅感觉丧失和截瘫。脑脊液检查压力正常，白细胞80×10⁶/L（80个／mm³），淋巴细胞占80%，蛋白轻度增高，最可能的诊断为
A. 脊髓出血
B. 急性脊髓炎
C. 脊髓肿瘤
D. 多发性硬化
E. 急性硬膜外脓肿

正确答案：B。急性脊髓炎

解析：患者青年女性，起病急，病程短，起病两天即出现胸4水平以下深浅感觉丧失和截瘫，体温正常，脑脊液检查压力正常，白细胞80×10⁶/L【正常值为（0-5）×10⁶/L】，淋巴细胞占80％，蛋白轻度增高，应为病毒性感染所致，考虑诊断为急性脊髓炎（B对）。脊髓出血（A错）起病急骤伴有剧烈背痛，脑脊液呈血性，无横贯性截瘫表现（P334）。脊髓肿瘤（C错）进展缓慢，多表现为慢性脊髓压迫症，脑脊液压力检查有梗阻。多发性硬化（D错）发病有缓解和复发交替病史，呈缓慢进展方式而病程至少1年以上，无横贯性截瘫表现（P262）。急性硬膜外脓肿（E错）有化脓性病灶，脑脊液压力检查有梗阻现象、白细胞增高、蛋白含量明显升高。